“疳者甘也”，即指其病因是由于对肥甘饮食的
A. 恶食
B. 限食
C. 少食
D. 喜食
E. 多食

正确答案：E。多食

解析：疳证是由喂养不当或多种疾病影响，导致脾胃受损，气液耗伤而形成的一种慢性疾病，乳食无度，多食肥甘厚味，以致食积内停，积久成疳（E对）。恶食肥甘饮食多形成厌食（A错）。限食肥甘厚腻之物可致小儿营养不良，长久可致厌食（B错）。少食肥甘饮食与恶食、限食后果一样（C错）。喜食并不一定多食，不一定会导致疳证（D错）。